咳声重浊者，多属
A. 风寒
B. 寒湿
C. 痰饮
D. 燥热
E. 肺热

正确答案：A。风寒

解析：外感风寒，可见咳声重浊（A对）。寒湿，可见咳声沉闷（B错）。痰饮，可见咳而声低，痰多而易咳出（C错）。燥热，可见咳声清脆（D错）。肺热，可见咳声不扬，痰稠色黄，不易咳出，咽喉干痛，鼻出热气（E错）。根据九版中医诊断学，咳声重浊沉闷，多属实证，是寒痰湿浊停聚于肺，肺失肃降所致。